污染物在环境介质中的迁移速度，最快的是
A. 水
B. 大气
C. 土壤
D. 植物
E. 岩石

正确答案：B。大气

解析：本题考查污染物在环境介质中的迁移速度。污染物在环境介质中的迁移速度，最快的是大气（B对ACDE错）。空气对流的迁移作用最强，在大气的对流层中，有规则的对流和无规则的湍流，直接影响物质的迁移。